关于健康教育与健康促进的关系的正确叙述是
A. 健康教育是健康促进的深化与发展
B. 健康促进以健康教育为先导
C. 与健康促进相比，健康教育融客观的支持和主观的参与于一体
D. 健康促进是健康教育的核心
E. 健康教育对健康促进起维护和推动作用

正确答案：B。健康促进以健康教育为先导